下列哪项不是中度水肿的特点
A. 全身疏松组织均有可见性水肿
B. 外阴部明显水肿
C. 指压后可出现明显的组织下陷
D. 平复缓慢
E. 指压后可出现较深的组织下陷

正确答案：B。外阴部明显水肿

解析：水肿是人体血管外组织间隙有过多的体液积聚使组织肿胀，按波及的范围可分为全身性水肿和局部性水肿，按水肿的严重程度可分为轻、中、重三度。轻度：仅见于眼睑、眶下软组织、胫骨前、踝部皮下组织，指压后可见组织轻度下陷，平复较快。中度：全身组织均见明显水肿（A对），指压后可出现明显的或较深的组织下陷（CE对），平复缓慢（D对）。重度：全身组织严重水肿，身体低位皮肤紧张发亮，甚至有液体渗出，此外，胸腔、腹腔等浆膜腔内可见积液，外阴部亦可见严重水肿（B错，为本题正确答案）。